在鉴别肠道致病菌和非致病菌的单糖发酵试验中，具有鉴别意义的糖是
A. 葡萄糖
B. 麦芽糖
C. 蔗糖
D. 菊糖
E. 乳糖

正确答案：E。乳糖

解析：肠杆菌科中有少数细菌易于引起人类疾病，如伤寒沙门菌、志贺菌、鼠疫耶尔森菌等，属于致病菌，致病菌不发酵乳糖，因此在鉴别肠道致病菌和非致病菌的单糖发酵试验中，具有鉴别意义的糖是乳糖（E对），可初步鉴别志贺菌、沙门菌等致病菌和其他大部分非致病肠道杆菌。